下列各项，适用“补托法”的是
A. 外疡中期，正虚毒盛
B. 初期肿疡
C. 溃疡后期，疮口难敛
D. 肿疡疮形已成
E. 蜂窝织炎破溃

正确答案：A。外疡中期，正虚毒盛

解析：托法是用补益气血和透脓的药物，扶助正气，托毒外出，以免毒邪扩散和内陷的治疗法则。托法适用于外疡中期即成脓期，此时热盛肉腐成脓，由于一时疮口不能溃破，或机体正气虚弱无力托毒外出，均会导致脓毒滞留。治疗上应根据病人体质强弱和邪毒盛衰状况，分为补托和透托两种方法（补托法用于正虚毒盛，正气不能托毒外达，疮形平塌、根脚散漫不收、难溃难腐的虚证（A对）。